属于酪氨酸衍生物的物质是
A. 组胺
B. 精胺
C. 腐胺
D. 5-羟色胺
E. 多巴胺

正确答案：E。多巴胺